精气血津液之间相互转化依靠气的
A. 推动作用
B. 温煦作用
C. 防御作用
D. 固摄作用
E. 气化作用

正确答案：E。气化作用

解析：气化，指气的运动所产生的各种变化，精、气、血、津液生成，都需要将饮食物转化为水谷之精气，再化生成精、气、血、津液等（E对）。气的推动作用是指气能推动血的生成、运行，以及津液的生成、输布、排泄等（A错）。气的温煦作用是指阳气对人体各脏腑组织的机能活动，以及生命物质代谢具有温煦作用（B错）。气的防御作用是指气有卫护机体、抗御邪气的作用（C错）。气的固摄作用是指气对体内精、血、津液等物质具有防止其无故流失的作用（D错）。